具有抗厌氧菌作用的抗虫药物是
A. 盐酸左旋咪唑
B. 吡喹酮
C. 乙胺嘧啶
D. 磷酸氯喹
E. 甲硝唑

正确答案：E。甲硝唑

解析：本题考查甲硝唑。具有抗厌氧菌作用的抗虫药物是甲硝唑（E对）。盐酸左旋咪唑（A错）是广谱驱肠虫药。吡喹酮（B错）对虫体可起两种主要药理作用，一是使虫体肌肉发生强直性收缩而产生痉挛性麻痹；二是对虫体皮层有迅速而明显的损伤作用。乙胺嘧啶（C错）具有二氢叶酸还原酶抑制作用。磷酸氯喹（D错）通过插入DNA双螺旋链发挥抗虫作用。